知母的药用部位是
A. 根
B. 根茎
C. 块茎
D. 根及根茎
E. 鳞茎

正确答案：B。根茎

解析：本题考查的是知母的来源。知母的药用部位是根茎（B对）。知母：【来源】为百合科植物知母的干燥根茎。入药部位为根（A错）的中药有牛膝、川牛膝、商陆、银柴胡、白芍、赤芍、板蓝根、地榆、苦参、葛根、粉葛、黄芪、西洋参、白芷、当归等。入药部位为块茎（C错）的中药有延胡索、三棱、泽泻、天南星、半夏、白及等。入药部位为根及根茎（D错）的中药有大黄、山豆根、甘草、三七、龙胆、紫菀、细辛、威灵仙、人参、红参、徐长卿、白薇、丹参、茜草等。入药部位为鳞茎（E错）的中药有川贝母、浙贝母等。